按一级动力学消除的药物特点为
A. 药物的半衰期与剂量有关
B. 为绝大多数药物的消除方式
C. 单位时间内实际消除的药量不变
D. 单位时间内实际消除的药量递增
E. 体内药物经2-3个t½后，可基本清除干净

正确答案：B。为绝大多数药物的消除方式

解析：一级消除动力学是体内药物按恒定比例消除，在单位时间内的消除量与血浆药物浓度成正比，大多数药物在体内按一级动力学消除（B对），其特点有：①恒比消除即单位时间内体内药物按恒定比例消除，血中药物消除速率与血中药物浓度成正比（CD错）；②半衰期恒定（A错），为一个常数（P17）③相同剂量相同间隔时间给药途径经5个半衰期达稳态浓度，按一级动力学消除的药物经过第一个半衰期可消除50%，经过两个半衰期消除75%，经过5个半衰期体内药物清除约97%，也就是说约经5个半衰期药物可从体内基本消除（E错）。